以下有关龋病好发年龄的论述中，不恰当的是
A. 3岁以前的幼儿多在前牙邻面患龋
B. 青少年多发生恒牙窝沟龋
C. 8岁左右乳磨牙的邻面龋开始增多
D. 3～5岁多见乳磨牙的窝沟龋
E. 青少年多发生根面龋

正确答案：E。青少年多发生根面龋

解析：本题考查龋病好发年龄。以下有关龋病好发年龄的论述中，不恰当的是青少年多发生根面龋（E错，为本题正确答案）。根面龋多见于中老年人，青少年较少见。3岁以前的幼儿多在前牙邻面患龋（A对），与饮食有关；3～5岁多见乳磨牙的窝沟龋（D对），与牙齿初萌有关；8岁左右，乳磨牙的邻面龋开始增多（C对），与颌骨生长后牙间隙增大有关；青少年多发生恒牙窝沟龋（B对）和上前牙的邻面龋。